女，28岁，间歇性牙龈出血1年。体检：双下肢可见散在出血点及紫斑，肝脾不大，余无异常。血红蛋白110g/L，红细胞42×1012/L，白细胞60×109/L，分类正常，血小板28×109/L。首选治疗药物是
A. 输血小板浓缩液
B. 抗纤溶药物
C. 免疫抑制剂
D. 脾切除
E. 肾上腺皮质激素

正确答案：E。肾上腺皮质激素

解析：一般情况下糖皮质激素治疗为首选治疗，近期有效率约为80%。掌握“特发性血小板减少性紫癜（ITP）”知识点。